全冠修复后引起龈炎的原因不包括下列哪项
A. 食物嵌塞
B. 咬合不平衡
C. 边缘过长
D. 边缘不密合
E. 光洁度差，边缘粗糙

正确答案：B。咬合不平衡

解析：本题考查修复后可能出现的问题-龈缘炎。全冠修复后引起龈炎的原因不包括咬合不平衡（B错，为本题的正确答案）。修复体粘固后可出现龈缘炎，表现为修复体龈边缘处的龈组织充血、水肿、易出血、疼痛等。其原因可能是：1.修复体轴面外形不良使食物直接冲击牙龈或不能对牙龈起到按摩作用；2. 冠边缘过长（C对），边缘抛光不良，光洁度差，边缘粗糙（E对），修复体边缘有悬突或台阶导致边缘不密合（D对）；3.试冠、戴冠时外力对牙龈的机械损伤；4.嵌塞食物压迫致牙龈损伤（A对）；咬合不平衡可引起早接触、（牙合）创伤等问题，一般不会引起龈炎。